下牙槽神经阻滞麻醉时发生面瘫的主要原因是
A. 注射点过低
B. 针尖刺入过深
C. 针尖刺入过前
D. 针尖刺入过后
E. 麻药注射入血管内

正确答案：D。针尖刺入过后

解析：本题考查局部麻醉并发症及防治。一般多见于下牙槽神经口内阻滞麻醉时，由于注射针偏向外后（D对）不能触及骨面，或偏上越过乙状切迹，而致麻药注入腮腺内麻醉面神经而发生暂时性面瘫；也偶见于咀嚼肌神经注射过浅所致。这种情况待麻醉药作用消失后，神经功能即可恢复，故勿需特殊处理。